临床试验的研究对象是
A. 患者个体
B. 患者群体
C. 未患病的个体
D. 未患病的人群
E. 抗体阴性的人群

正确答案：B。患者群体

解析：本题考查临床试验的研究对象。临床试验强调以病人个体为单位进行试验分组和施加干预措施，其研究对象是病人群体（B对ACDE错）。